临床上最常见的幻觉是
A. 幻视
B. 幻听
C. 幻嗅
D. 幻味
E. 幻触

正确答案：B。幻听